内脏痛的主要特点是
A. 刺痛
B. 慢痛
C. 定位不精确
D. 必有牵涉痛
E. 对牵拉不敏感

正确答案：C。定位不精确

解析：内脏痛的主要特点是定位不精确（C对）。内脏痛主要表现为慢痛，常呈渐进性增强，但有时也可迅速转为剧烈疼痛，但不是主要特点（AB错）。牵涉痛（D错）是较为特殊的内脏痛，和内脏痛不是必然的关系。内脏痛对扩张性刺激和牵拉性刺激十分敏感（E错），而对切割、烧灼等通常易引起皮肤痛的刺激却不敏感。